沙苑子的功效是
A. 益肾补肺
B. 祛寒除湿
C. 养肝明目
D. 补阴益阳
E. 益气养血

正确答案：C。养肝明目

解析：本题考查沙苑子的功效。沙苑子的功效是养肝明目（C对）。沙苑子【功效】补肾固精，养肝明目。冬虫夏草【功效】益肾补肺（A错），止血化痰。仙茅【功效】补肾壮阳，强筋健骨，祛寒除湿（B错）。大枣【功效】补中益气，养血（E错）安神，缓和药性。